龙骨与牡蛎的共同作用是
A. 平肝熄风
B. 平肝潜阳
C. 软坚散结
D. 清肝明目
E. 补肾健骨

正确答案：B。平肝潜阳

解析：牡蛎具有的功效是潜阳补阴，重镇安神，软坚散结，收敛固涩，制酸止痛。龙骨具有的功效是镇惊安神，平肝潜阳，收敛固涩。龙骨与牡蛎的共同作用是平肝潜阳（B对），收敛固涩，安神。羚羊角的功效是平肝熄风（A错），清肝明目，清热解毒。鳖甲的功效是滋阴潜阳，软坚散结（C错），退热除蒸。石决明的功效是平肝潜阳，清肝明目（D错）。龟甲的功效是滋阴潜阳，补肾健骨（E错），养血补心。